根据Atwood牙槽嵴吸收程度分级，后部呈凹陷状牙槽嵴属于
A. 零级
B. 一级
C. 二级
D. 三级
E. 四级

正确答案：E。四级

解析：本题考查Atwood牙槽嵴吸收程度分级。根据Atwood牙槽嵴吸收程度分级，后部呈凹陷状牙槽嵴属于四级（E对）。Atwood根据无牙颌牙槽嵴的形态，将牙槽嵴吸收程度分为四级：（1）一级（B错）：牙槽嵴吸收较少，有一定的高度和宽度，形态丰满者；（2）二级（C错）：高度降低，尤其是宽度明显变窄，呈刀刃状的牙槽嵴；（3）三级（D错）：高度明显降低，牙槽嵴大部分吸收而低平者；（4）四级：牙槽嵴吸收达基骨，牙槽嵴后部形成凹陷者。